女性，85岁。20年来反复发作右面部闪电样疼痛。说话和鼻翼旁触摸诱发疼痛．今年已痛10月未缓解。诊断为三叉神经痛。选用卡马西平止痛的有效率约为
A. 40%
B. 50%
C. 60%
D. 70%
E. 80%

正确答案：D。70%

解析：三叉神经痛选用卡马西平止痛的有效率约为70%-80%。但患者年龄85岁。面部闪电样疼痛20年来反复发作，因此有效率会有些许下降，虽然DE都正确，但D项更加合理，原答案为D。